对咬合异常并有症状、体征的患者修复前应
A. 拔除
B. 正畸治疗
C. 牙槽骨成形术
D. 临床牙冠延长
E. 咬合调整与选磨

正确答案：E。咬合调整与选磨

解析：本题考查修复前准备。咬合调整的目的是引导力沿牙长轴传导；使所有牙正中颌位时均有接触；使正中关系与正中颌位（牙尖交错位）协调一致；建立尖牙保护（牙合）或组牙功能（牙合）。对咬合异常并有症状、体征的患者，修复前可以通过（牙合）垫、诊断性调（牙合）、临床调（牙合）（E对）进行纠正。